以下哪种流行病学研究会应用到随机分组
A. 现场试验
B. 队列研究
C. 抽样调查
D. 个案报告
E. 病例对照研究

正确答案：A。现场试验

解析：本题考查实验流行病学随机分组的特性。现场试验（A对）属于实验流行病学，它是以尚未患病的人作为研究对象，会应用到随机分组。队列研究（B错）是将是否暴露于可疑因素分组。抽样调查（C错）和个案报告（D错）属于描述性研究的类型，不涉及分组。病例对照研究（E错）是以是否患病分组。